中药苦杏仁中所含的主要活性成分是
A. 黄酮
B. 氰苷
C. 香豆素
D. 木脂素
E. 强心苷

正确答案：B。氰苷